椎管内穿刺时脑脊液流出，表示穿刺针到达
A. 硬膜外隙
B. 硬膜下隙
C. 蛛网膜下隙
D. 软脊膜下面
E. 以上都不是

正确答案：C。蛛网膜下隙

解析：腰椎穿刺脑脊液流出，表示穿刺针到达蛛网膜下隙（C对）。